引起气性坏疽的主要病原体是
A. 炭疽杆菌
B. 产气荚膜杆菌
C. A族链球菌
D. 葡萄球菌
E. 绿脓杆菌

正确答案：B。产气荚膜杆菌